AB=SB见于
A. 代谢性酸中毒
B. 呼吸性酸中毒
C. 代谢性碱中毒
D. 呼吸性碱中毒
E. 酸碱平衡正常

正确答案：E。酸碱平衡正常

解析：标准碳酸氢盐(SB)是标准化HCO3-后测量的数值，所以只受代谢因素影响，实际碳酸氢盐(AB)是指在隔绝空气的条件下测得的实际HCO3-，因而受呼吸和代谢两方面的影响。正常人AB与SB 相等（E对），若SB正常，而AB>SB 时，表明有CO2滞留，可见于呼吸性酸中毒（B错）；反之AB<SB,则表明CO2排出过多，见于呼吸性碱中毒（D错）。当发生代谢性酸中毒（A错）时，由于呼吸代偿性加深加快，CO2排出过多，与呼吸性碱中毒一样会导致AB<SB；当发生代谢性碱中毒（C错）时，由于呼吸代偿性减慢，CO2潴留，与呼吸性酸中毒一样会导致AB>SB。